属于内负荷指标的是
A. 血铅
B. 空气铅
C. 尿硫醚
D. 锌原卟啉
E. 尿酚

正确答案：A。血铅